骨龄超前常见于
A. 生长激素缺乏症
B. 甲状腺功能减低症
C. 肾小管酸中毒
D. 先天性肾上腺皮质增生症
E. 以上都不是

正确答案：D。先天性肾上腺皮质增生症

解析：用X线检查测定不同年龄儿童长骨干骺端骨化中心的出现时间、数目、形态的变化，并将其标准化，即为骨龄，而骨生长与生长激素、甲状腺素、性激素有关，故这几种激素的分泌对于骨龄有着重要影响。先天性肾上腺皮质增生症会导致骨龄超前（D对）。生长激素缺乏症（A错）、甲状腺功能减低症（B错）会导致骨龄明显延后。